轮状病毒直径是
A. 50～65nm
B. 60～80nm
C. 80～95nm
D. 60～75nm
E. 90～100nm

正确答案：B。60～80nm

解析：轮状病毒呈球形，直径60～80nm，核心为双股RNA（dsRNA），由11个基因片段组成，外有双层衣壳呈车轮辐条状，故称为轮状病毒。掌握“胃肠道病毒”知识点。